氯化钾静滴浓度不得超过
A. 0.1%
B. 0.3%
C. 0.6%
D. 0.9%
E. 1.2%

正确答案：B。0.3%

解析：氯化钾静滴浓度不得超过0.30% （B对）。若浓度超过0.30%，会使血钾浓度升高，易发生心脏停搏的危险。